符合肠易激综合征临床特点的是
A. 与食物无明显关系
B. 症状多进行性加重
C. 可伴有精神心理障碍
D. 常出现明显的体重下降
E. 好发于老年男性

正确答案：C。可伴有精神心理障碍

解析：肠易激综合征（IBS）是一种以腹痛或腹部不适伴排便习惯改变为特征而无器质性病变的常见功能性肠病，多发生于中青年，老年男性少见（E错）。精神和饮食因素（A错）可以诱使肠易激综合征复发或加重，因此其可伴有精神障碍（C对）。肠易激综合征症状常反复发作或迁延（B错），不会引起健康状况改变，无明显的体重下降（D错）。